病理性黄疸，下列错误的是
A. 黄疸出现时间较早或太晚
B. 黄疸程度较重
C. 黄疸持续时间较短
D. 黄疸进展快
E. 有伴随症状

正确答案：C。黄疸持续时间较短

解析：病理性黄疸出现早、发展快（D对）、程度重（B对）、消退迟（C错，为本题正确答案）或黄疸退而复现（A对）。足月儿总胆红素超过342 umol/L可引起胆红素脑病（核黄疽），损害中枢神经系统，遗留后遗症（E对）。